枕先露，先露+2，胎膜已破，第一产程末，胎儿电子监护时可出现
A. 早期减速
B. 晚期减速
C. 变异减速
D. 基线胎心率有变异
E. 周期性胎心率加速

正确答案：A。早期减速

解析：胎儿枕先露，先露＋2，胎膜已破，提示胎头双顶径越过骨盆出口，即胎头着冠，第二产程宫缩频而强，宫缩时胎头受压，胎儿电子监护表现为早期减速（A对），早期减速一般发生在第一产程后期，也可发生在第二产程。晚期减速（B错）是胎盘功能不良，胎儿缺氧的表现，变异减速（C错）发生于脐带受压时，本例并未出现。基线胎心率有变异（D错）是指胎心率有小的周期性变动，与周期性胎心率加速（E错）都是正常的胎动变化。